颈内动脉虹吸部是指
A. 颈部
B. 岩部
C. 颈部和岩部
D. 岩部和海绵窦部
E. 海绵窦部和前床突上部

正确答案：E。海绵窦部和前床突上部

解析：颈内动脉按其行程可分为4部：颈部、岩部、海绵窦部和前床突上部。其中颈内动脉的海绵窦部和前床突上部（E对）合称为虹吸部。